经产妇，28岁。妊娠37周，阴道无痛性多量流血5小时入院。查体：血压80/60mmHg，脉搏102次/min。无宫缩，宫底在剑突下2横指，臀先露，胎心94次/min，骨盆外测量正常。本例最可能的诊断是
A. 先兆临产
B. 正常产程
C. 前置胎盘
D. 胎盘早剥
E. 先兆子宫破裂

正确答案：C。前置胎盘